截根术常用于
A. Ⅰ度根分叉病变
B. Ⅰ和Ⅱ度根分叉病变
C. Ⅱ根分叉病变
D. Ⅲ和Ⅳ度根分叉病变
E. Ⅴ度根分叉病变

正确答案：D。Ⅲ和Ⅳ度根分叉病变

解析：本题考查根分叉病变。截根术常用于磨牙的Ⅲ度或Ⅳ度根分叉病变（D对）。